治疗耐甲氧西林金黄色葡萄球菌有效的药物是
A. 阿米卡星
B. 万古霉素
C. 利福平
D. 盐酸克林霉素
E. 红霉素

正确答案：B。万古霉素

解析：本题考查万古霉素。万古霉素（B对）对革兰阳性菌具有强大的抗菌活性，主要用于耐药金黄色葡萄球菌或对β-内酰胺类抗菌药物过敏的严重感染。阿米卡星（A错）属于氨基糖苷类抗菌药，抗菌谱广，对各种革兰阴性菌具有强大抗菌活性，对革兰阴性球菌作用较差。利福平（C错）对结核杆菌和麻风杆菌作用强。盐酸克林霉素（D错）对需氧革兰阳性球菌和厌氧菌有良好抗菌活性。红霉素（E错）用于耐青霉素的金葡菌引起的轻、中度感染或青霉素过敏者。